男，60岁。间断咳嗽、咳脓痰10余年。查体：双上肺可闻及湿啰音。胸部X线片示双上肺多个透亮区，未见液平，双侧肺门上提。最可能的诊断是
A. 慢性肺脓肿
B. 慢性阻塞性肺疾病
C. 慢性纤维空洞性肺结核
D. 过敏性支气管肺曲霉病
E. 支气管扩张

正确答案：C。慢性纤维空洞性肺结核

解析：中老年男性患者，咳嗽、咳脓痰、湿啰音，胸部X线片示双上肺多个透亮区，未见液平，双侧肺门上提。最可能的诊断是慢性纤维空洞性肺结核（C对）。纤维空洞性肺结核病程长，反复进展恶化，肺组织破坏重，肺功能严重受损，双侧或单侧出现纤维厚壁空洞和广泛的纤维增生，造成肺门抬高和肺纹理呈垂柳样，患侧肺组织收缩，纵隔向患侧移位，常见胸膜粘连和代偿性肺气肿。慢性肺脓肿（A错）临床特征为高热、咳嗽和咳大量脓臭痰，胸部X线检查可见局部浓密炎症阴影，肺实质内厚壁空洞或伴液平（P57-P58）。慢性阻塞性肺疾病（B错）主要症状包括：慢性咳嗽、咳痰、气短或呼吸困难、喘息和胸闷、桶状胸、双侧语颤减弱、肺部过清音、部分病人可闻及湿啰音和（或）干啰音。胸部X线检查慢阻肺早期胸片无异常变化。以后可出现肺纹理增粗、紊乱等非特异性改变，也可出现肺气肿（P23）。过敏性支气管肺曲霉病（D错）病人喘息、畏寒、发热、乏力、刺激性咳嗽、咳棕黄色脓痰，偶带血。痰中有大量嗜酸性粒细胞及曲霉丝，烟曲霉培养阳性。哮喘发作为其突出的临床表现，一般解痉平喘药难以奏效。胸片或CT显示中央性支气管扩张（肺野内侧2/3的支气管）和一过性肺浸润，表现为上叶一过性实变或不张，磨玻璃阴影伴马赛克征，黏液嵌塞，可发生于双侧（P55-P56）。支气管扩张（E错）（P37）。